新生儿皮肤粘膜特点
A. 皮肤无胎脂覆盖
B. 角质层较厚
C. 口腔黏膜血管少
D. 唾液腺发育不良
E. 牙龈切缘可见黄白色小点

正确答案：E。牙龈切缘可见黄白色小点

解析：新生儿皮肤呈粉红色，皮肤表面有一层薄白色胎脂（A错）。皮肤细嫩，角质层较薄，保护功能不强（B错）。口腔粘膜光滑薄嫩，毛细血管丰富（C错）。唾液腺发育不完善，并非发育不良，唾液分泌少，保护功能弱（D错）。牙龈及上腭可见黄白色小点为上皮细胞或黏液腺分泌物积留形成，俗称“马牙”，数周后可自然消退，属于一种特殊的生理状态（E对）。